支撑呼吸道的软骨是
A. 甲状软骨
B. 杓状软骨
C. 环状软骨
D. 麦状软骨
E. 会厌软骨

正确答案：C。环状软骨

解析：喉的支架由甲状软骨、环状软骨、会厌软骨和成对的杓状软骨等喉软骨构成，可以支撑呼吸道，保持其畅通的是环状软骨（C对）。甲状软骨是最大的喉软骨，位于环状软骨与会厌软骨之间，构成喉的前壁和侧壁（A错）。杓状软骨软骨位于环状软骨板上方中线两侧，形似三棱锥体形，是成对的喉软骨（B错）。麦状软骨不属于喉软骨的构成（D错）。会厌软骨位于舌骨体后方，形似树叶，上宽下窄，上端游离，下端借甲状会厌韧带连于甲状软骨前角内面的上部（E错）。